关于非线性药物动力学特点的说法，正确的是
A. 消除呈现一级动力学特征
B. AUC与剂量成正比
C. 剂量增加，消除半衰期延长
D. 平均稳态血药浓度与剂量成正比
E. 剂量增加，消除速率常数恒定不变

正确答案：C。剂量增加，消除半衰期延长

解析：本题考查非线性药动学。当剂量增加时，消除半衰期延长（C对）；非线性药动学药物消除不呈现一级动力学特征（A错）；AUC、Cmax也不与剂量成正比关系（BD错）；消除动力学是非线性的（E错）。